患者，男，30岁。长期在电脑前工作，近一年时感视力疲劳，两目干涩，头昏脑涨，腰膝酸痛，舌质略红，脉细涩。用药首选
A. 夏枯草决明子
B. 龙胆草夏枯草
C. 桑叶菊花
D. 菊花枸杞子
E. 菊花决明子

正确答案：D。菊花枸杞子

解析：菊花的功效为疏散风热，平抑肝阳，清肝明目，清热解毒。治疗目赤肿痛，眼目昏花。若肝肾精血不足，目失所养，眼目昏花，视物不清，又常配伍枸杞子、熟地黄、山茱萸等滋补肝肾、益阴明目药，如杞菊地黄丸（D对）。夏枯草治疗目赤肿痛，目珠夜痛，头痛眩晕，瘿瘤，瘰疬，乳痈，乳癖，乳房胀痛。决明子治疗目赤涩痛，羞明多泪，目暗不明，头痛眩晕，肠燥便秘（AE错）。龙胆草治疗湿热黄疸，阴肿阴痒，带下，湿疹瘙痒，肝火头痛，目赤肿痛，耳鸣耳聋，胁痛口苦，强中，惊风抽搐（B错）。桑叶治疗风热感冒，温病初起，肺热咳嗽，燥热咳嗽，肝阳上亢，头痛眩晕，目赤肿痛，目暗昏花。菊花治疗风热感冒，温病初起，肝阳上亢，头痛眩晕，目赤肿痛，眼目昏花，疮痈肿毒（C错）。